后牙金属烤瓷冠牙体预备时（牙合）面降低的厚度应大于
A. 1mm
B. 2.5mm
C. 3mm
D. 2mm
E. 0.5mm

正确答案：D。2mm

解析：本题考查后牙金属烤瓷冠的牙体预备。后牙金属烤瓷冠牙体预备时（牙合）面降低的厚度应大于2mm（D对）。后牙金属烤瓷冠牙体预备的要求与铸造全冠及前牙烤瓷全冠相近。应按照设计满足固位、金瓷修复材料空隙和美观方面的要求。前磨牙面通常设计为瓷覆盖，故面降低厚度2.0mm，磨牙视患者要求或美观需要或为瓷覆盖或为部分瓷覆盖，少数情况下也可设计成瓷颊面，根据修复设计降低牙面的高度也不同。